下列情况中属于合理使用非处方药的是
A. 将布洛芬用于治疗类风湿性关节炎、滑膜炎
B. 将西咪替丁用于治疗胃、十二指肠溃疡
C. 妊娠期妇女长期大量使用鱼肝油丸
D. 小儿使用对乙酰氨基酚1天即退热，立即停药
E. 将颠茄流浸膏片连续给小儿服用3天治疗胃肠痉挛

正确答案：D。小儿使用对乙酰氨基酚1天即退热，立即停药